激动时使骨骼肌收缩的是
A. α受体
B. β₁受体
C. β₂受体
D. M受体
E. N₂受体

正确答案：E。N₂受体